固体分散体的难溶性载体材料是
A. 聚乙烯吡咯烷酮
B. 乙基纤维素
C. β-环糊精
D. 磷脂和胆固醇
E. 聚乳酸

正确答案：B。乙基纤维素

解析：本题考查固体分散体的难溶性载体材料。固体分散体常用的难溶性载体材料有乙基纤维素（EC）（B对）、含季铵基的聚丙烯酸树脂Eudragit（包括E、RL和RS等几种）。聚乙烯吡咯烷酮（聚维酮）（A错）为亲水凝胶骨架材料。β-环糊精（C错）为制备包合物的包合材料。磷脂和胆固醇（D错）为制备脂质体的膜材料。聚乳酸（E错）常用作缓释骨架材料、微囊囊膜材料和微球成球体材料。